新生儿，足月顺产，出生体重3.3kg。无新生儿窒息。开奶的时间为产后
A. 2-3小时
B. 24小时
C. 12小时
D. 15分钟至2小时内
E. 6小时

正确答案：D。15分钟至2小时内

解析：尽早开奶可减轻婴儿生理性黄疸，同时还可减轻生理性体重下降、低血糖的发生。产后15分钟～2小时（D对）即可通过吸吮开奶。